某男，39岁，肛内肿物脱出，肛管紧缩，坠胀疼痛，触痛明显，舌质暗红，苔薄白，脉细涩，中医辨证为内痔气滞血瘀证，治宜选用的方剂是
A. 止痛如神汤
B. 凉血地黄汤
C. 补中益气汤
D. 桃仁承气汤
E. 四妙勇安汤

正确答案：A。止痛如神汤

解析：本题考查的是痔疮的辨证论治。肛内肿物脱出，肛管紧缩，坠胀疼痛，触痛明显，舌质暗红，苔薄白，脉细涩，中医辨证为内痔气滞血瘀证，治宜选用的方剂是止痛如神汤（A对）。痔是指直肠末端黏膜下和肛管皮肤下的静脉丛发生扩大、曲张所形成的柔软静脉团。（一）风伤肠络证：【方剂应用】基础方剂为凉血地黄汤（B错）（细生地、当归尾、地榆、槐角、黄连、天花粉、升麻、赤芍、枳壳、黄芩、荆芥、生甘草、生侧柏）加减。（二）湿热下注证：【治法】清热利湿止血。【方剂应用】基础方剂为脏连丸（黄连、黄芩、赤芍、当归、阿胶珠、荆芥穗、炒槐花、地榆炭、地黄、蜜炙槐角、猪大肠）加减。（三）气滞血瘀证：【方剂应用】基础方剂为止痛如神汤（秦艽、桃仁、皂角子、苍术、防风、黄柏、当归、泽泻、槟榔、熟大黄）加减。（四）脾虚气陷证：【方剂应用】基础方剂为补中益气汤（C错）（黄芪、人参、炙甘草、当归、橘皮、升麻、柴胡、白术）加减。方剂应用为桃仁承气汤（D错）与四妙勇安汤（E错）的病证，2022年考试指南未明确说明。